孕产妇死亡率较低的疾病是
A. 妊娠期高血压病
B. 产后出血
C. 产褥感染
D. 妊娠合并糖尿病
E. 妊娠合并肝炎

正确答案：E。妊娠合并肝炎

解析：孕产妇死亡率较高的疾病是妊娠期高血压病（A错）、产后出血（B错）、妊娠合并心脏病、产褥感染（C错）、妊娠合并糖尿病（D错），妊娠合并重症肝炎（E对）孕产妇死亡率较低的疾病。